原发性心肌舒缩功能障碍的原因常见于：
A. 主动脉瓣狭窄
B. 心肌炎
C. 主动脉辦关闭不全
D. 二尖瓣关闭不全
E. 高血压

正确答案：B。心肌炎

解析：原发性心肌舒缩功能障碍是指各种病因通过直接损害心肌，而不是长期增加心脏负荷使心脏失代偿引起的心肌舒缩功能减退。感染性心肌炎（B对）时，致病微生物感染及其介导的免疫损伤可直接导致心肌细胞的变性、坏死，造成心肌收缩功能减退。主动脉瓣狭窄（A错）、主动脉瓣关闭不全（C错）、二尖瓣关闭不全（D错）、高血压（E错）均通过增加心脏前/后负荷并最终使心脏失代偿导致心肌舒缩功能减退，而不是通过直接损害心肌导致，因而不属于原发性心肌舒缩功能障碍。